环境污染物的暴露一般是通过
A. 直接摄入污染物
B. 接触含有这些污染物的土壤
C. 接触含有这些污染物的生物
D. 接触含有这些污染物的水
E. 接触含有这些污染物的环境介质

正确答案：E。接触含有这些污染物的环境介质

解析：本题考查环境污染物的暴露相关内容。即便是同一污染来源，由于环境介质（E对ABCD错）的物质迁移作用可以在不同介质之间进行，许多环境有害化学物进入环境后都会在多种介质存在。通过这些介质，环境有害化学物经呼吸道、消化道、皮肤暴露途径进入人体。